某药按一级动力学消除，半衰期为7小时，采用恒量连续给药，达到稳态血药浓度99%以上的最短时间是
A. 5天左右
B. 10天左右
C. 10小时左右
D. 1天左右
E. 2天左右

正确答案：E。2天左右